体内脂肪酸合成的主要原料是
A. NADPH和乙酰CoA
B. NADH和乙酰CoA
C. NADPH和丙二酰CoA
D. NADPH和乙酰乙酸
E. NADH和丙二酰CoA

正确答案：A。NADPH和乙酰CoA